男，38岁，间歇性浮肿10余年，伴恶心、呕吐1周。查血红蛋白80g/L，血压20.7/14.7kPa（155/110mmHg），尿蛋白++，颗粒管型2～3个/HP，尿比重1.010～1.012。可能的诊断是
A. 肝炎后肝硬化
B. 原发性高血压
C. 慢性肾盂肾炎
D. 慢性肾小球肾炎
E. 肾病综合征

正确答案：D。慢性肾小球肾炎

解析：青年男性患者，既往间歇性水肿10余年（考虑为水、钠潴留引起），伴恶心呕吐1周（伴发消化道症状）。查血红蛋白80g/L（正常为120～160g/L，提示有贫血），血压155/110mmHg（正常为90～130/60～90mmHg，提示有高血压），尿蛋白++（正常为阴性，提示有蛋白尿），颗粒管型2～3个/HP（正常为阴性，提示有管型尿），尿比重1.010～1.012（正常为1.015～1.025，提示尿比重降低），蛋白尿、管型尿、低比重尿均为肾功能损害的表现。患者出现尿化验异常（蛋白尿）伴水肿及高血压病史达三个月以上，且有肾功能损害的表现，可能的诊断是慢性肾小球肾炎（D对）。肝炎后肝硬化（P406）（A错）是肝炎患者肝细胞坏死后再生被增生的纤维分割成假小叶所致，主要表现为肝功能受损。原发性高血压（P250）（B错）肾损害好发于老年人，多有长期高血压病史，肾脏损害较轻，且多以夜尿增多为首发症状。慢性肾盂肾炎（P493）（C错）多有反复发作的泌尿系统感染史，并有影像学及肾功能异常，尿沉渣中常有白细胞，尿细菌学检查阳性。肾病综合征（P470）（E错）常表现为大量蛋白尿、低蛋白血症，伴（不伴）水肿、高脂血症等。